不得与含麻黄的中成药联用的成药有
A. 速效救心丸
B. 活心丹
C. 山海丹胶囊
D. 益心丸
E. 滋心阴口服液

正确答案：A、B、C、D、E。速效救心丸；活心丹；山海丹胶囊；益心丸；滋心阴口服液

解析：本题考查的是中成药联用的配伍禁忌。不得与含麻黄的中成药联用的成药有速效救心丸（A对）、活心丹（B对）、山海丹胶囊（C对）、益心丸（D对）与滋心阴口服液（E对）。某些药物的相互作用问题：含麻黄的中成药忌与降血压的中成药如复方罗布麻片、降压片、珍菊降压片、牛黄降压丸等并用；也忌与扩张冠脉的中成药如速效救心丸、山海丹、活心丹、心宝丸、益心丸、滋心阴液、补心气液等联用。因麻黄中麻黄碱的化学结构与肾上腺素相似，能直接与肾上腺素受体结合，同时还能促使肾上腺素能神经末梢释放介质，从而使血管收缩、血压升高；另一方面，又能兴奋心脏，增强心肌收缩力，使心肌耗氧量增加。若同时并用，可产生拮抗作用。含朱砂较多的中成药，如磁朱丸、更衣丸、安宫牛黄丸等与含较多还原性溴离子或碘离子的中成药如消瘿五海丸、内消瘰疬丸等长期同服，在肠内会形成有刺激性的溴化汞或碘化汞，导致药源性肠炎、赤痢样大便。